鼻翼耳屏线与眶耳平面的交角约
A. 5°
B. 10°
C. 15°
D. 30°
E. 45°

正确答案：C。15°

解析：本题考查（牙合）分类及临床意义与面部结构。鼻翼耳屏线是指从一侧鼻翼中点到同侧耳屏中点的假想连线，该线与（牙合）平面平行，与眶耳平面的交角约15°（C对）。